银杏+对乙酰氨基酚
A. 产生有利的药物相互作用
B. 抑制乙醛脱氢酶
C. 造成听觉神经和肾功能不可逆损害
D. 抑制氧化代谢反应
E. 诱发硬膜下血肿

正确答案：E。诱发硬膜下血肿